医疗机构临床用血应当制定用血计划，遵循
A. 公平、公正的原则
B. 慎用、节约的原则
C. 准确、慎用的原则
D. 合理、科学的原则
E. 勤查、深究的原则

正确答案：D。合理、科学的原则

解析：医疗机构临床用血应当制定用血计划，遵循合理、科学的原则，不得浪费和滥用血液。掌握“医疗机构临床用血管理、及法律责任”知识点。